抑郁发作时，1日之内的规律是
A. 昼轻夜重
B. 昼重夜轻
C. 中午起逐渐加重
D. 中午最严重以后减轻
E. 半夜最重

正确答案：B。昼重夜轻